牙周手术后常局部应用以控制菌斑的是
A. 麝香草酚
B. 氯己定
C. 四环素
D. 磺胺类
E. 甲硝唑

正确答案：B。氯己定

解析：在机械性控制菌斑的基础上，配合化学制剂可有效地控制菌斑，达到预防和治疗牙周病的目的。化学制剂必须依靠一些载体，如含漱剂、牙膏、口香糖、牙周袋冲洗液、缓释装置等才能被传递到牙周局部，起到控制菌斑的作用。氯己定又称洗必泰，化学名称为双氯苯双胍己烷，系二价阳离子表面活性剂，常以葡萄糖酸洗必泰的形式使用。掌握“慢性牙周炎的治疗原则、程序及方法”知识点。